女，60岁。双下肢水肿。既往高血压10年，平时血压140/90mmHg，糖尿病3年。尿蛋白3.8g/d，尿红细胞3～5/HP，血Alb29g/L，空腹Glu8.5mmol/L，Scr198umol/L。双侧眼底出血。以下最支持糖尿病肾病诊断的是
A. 空腹血糖高
B. 眼底出血
C. 水肿
D. 血肌酐升髙
E. 糖尿病病史3年

正确答案：B。眼底出血

解析：微血管病变是糖尿病的特异性并发症，可累计全身各组织器官，主要表现在视网膜、肾、神经和心肌组织，其中以糖尿病肾病和视网膜病变尤为重要。因此，最支持糖尿病肾病诊断的是眼底出血（B对）。空腹血糖高（A错）只能支持患者糖尿病的诊断。水肿（C错）是由大量蛋白尿导致的低蛋白血症所致，并不能支持糖尿病肾病诊断。血肌酐增高（D错）可见于多种肾脏疾病导致的肾功能受损，比如高血压肾损。糖尿病导致糖尿病肾病常需常达10年的病史，糖尿病病史3年（E错）时间太短，不足以证明，且患者高血压10年更有说服力。